距肛缘4～5cm的直肠癌，最常用的手术方式是
A. 直肠前切除术
B. 经腹直肠癌切除，远端封闭，近端造瘘术
C. 经腹会阴联合直肠癌根治术
D. 拉下式直肠癌切除术
E. 经直肠镜肿瘤切除术

正确答案：C。经腹会阴联合直肠癌根治术

解析：直肠癌手术方式的选择主要根据肿瘤距离肛缘的距离决定。肛缘5cm以内的直肠癌采取经腹会阴联合直肠癌根治术（C对），患者肿瘤距离肛缘4～5cm，应采用此法。直肠前切除术（A错）适用于直肠癌下缘距离肛缘5～7cm以上的肿瘤。经腹直肠癌切除，远端封闭，近端造瘘术（B错）适用于不能耐受Mils手术或者急性梗阻不宜行Dixon手术的患者。拉下式直肠癌切除术（D错）适用于距离肛缘7～10cm的直肠癌。该术式保留肛门，经肛门在齿状线上切断直肠，将乙状结肠从肛门拉下，固定于肛门。经直肠镜肿瘤切除术（E错）主要适用于恶性程度不高、且不能耐受根治术的早期直肠癌。